实脾散的组成药物中含有
A. 干姜、乌梅
B. 槟榔、芍药
C. 附子、木香
D. 白术、五味子
E. 茯苓、五倍子

正确答案：C。附子、木香

解析：本题考查方剂的组成，实脾散组成厚朴 白术 木瓜 木香 草果仁 大腹子 附子 白茯苓 干姜 甘草。附子在本方中的作用温肾阳而助气化而行水，木香行气导滞令气化则湿化（C对）。